可以用来评价某病因对居民健康状况影响的是
A. L’X
B. P’X
C. mX
D. e’X
E. r’X

正确答案：A。L’X

解析：本题考查反映居民健康状况的指标。L’x（A对BCDE错）是可以用来评价某病因对居民健康状况影响的指标。